SCE是
A. 染色单体交换
B. 姐妹染色单体交换
C. 染色单体互换
D. 姐妹染色体交换

正确答案：B。姐妹染色单体交换

解析：本题考查SCE。SCE是姐妹染色单体交换（B对ACD错），是指一条染色体的两条单体在同一位置发生同源片段的易位。